以下属于率的计算公式是
A. 率=一定时间内某现象实际发生的观察单位总数/该时间段开始时的观察单位总数×K
B. 率=该时间段开始时的观察单位总数/一定时间内某现象实际发生的观察单位总数×K
C. 率=甲指标/乙指标×100%
D. 率=乙指标/甲指标×100%
E. 率=事物内部某一组成部分的观察单位数/事物内部各组成部分观察单位总数

正确答案：A。率=一定时间内某现象实际发生的观察单位总数/该时间段开始时的观察单位总数×K

解析：率的公式：率=一定时间内某现象实际发生的观察单位总数/该时间段开始时的观察单位总数×K。掌握“分类资料的统计描述与推断”知识点。